先兆偏头痛的先兆特点是
A. 感觉先兆多为双侧麻木
B. 必须在头痛前发生而非与头痛同时发生
C. 视觉先兆多为偏盲
D. 多表现为偏侧运动障碍
E. 持续时间为5～60分钟

正确答案：E。持续时间为5～60分钟

解析：先兆症状在头痛之前或头痛发生时（B错）发生，持续时间不超过60分钟（E对），常以可逆的局灶性神经系统症状为先兆，表现为视觉、感觉、言语和运动的缺损或刺激症状（AD错）。最常见为视觉先兆，如视觉模糊、暗点、闪光、亮点亮线或事物变形（C错）。